正确描述颈内静脉的是
A. 由乙状窦和颈外静脉合成
B. 由乙状窦延续而成
C. 在颈总动脉和迷走神经后方下行
D. 无静脉瓣，故损伤时易致气栓
E. 主要属支为甲状腺下静脉和面静脉

正确答案：B。由乙状窦延续而成

解析：颈内静脉由乙状窦延续而成（B对）。沿颈内动脉和颈总动脉外侧（C错）下行，至胸锁关节后方与锁骨下静脉汇合成头臂静脉。